下列有关新合成的介质主要有
A. 细胞因子
B. 前列腺素
C. 白细胞三烯
D. 血小板活化因子
E. 以上说法均正确

正确答案：E。以上说法均正确

解析：新合成的介质：主要有白细胞三烯、血小板活化因子、前列腺素和细胞因子。白细胞三烯（LT）是晚期反应的主要介质，可刺激支气管平滑肌强烈持久地收缩，增加毛细血管的通透性，促进黏膜分泌。血小板活化因子（PAF）可刺激血小板释放组胺和5-羟色胺等血管活性物质。前列腺素可刺激支气管平滑肌收缩，引起毛细血管扩张。IL-4和IL-13可刺激Th2应答，促进B细胞产生IgE、IL-3、IL-5和GM-CSF。IL-5可促进嗜酸性粒细胞的生成和活化。掌握“概述及Ⅰ型超敏反应”知识点。